对手淫采取的措施应该是
A. 坚决制止
B. 服用药物
C. 大力提倡
D. 积极引导，防止频繁发生
E. 晓知利害，避免再次发生

正确答案：D。积极引导，防止频繁发生

解析：本题考查针对手淫不良行为该采取的的措施。手淫在不同程度上会影响青少年的身心健康，对性心理发展可产生不良影响，手淫并不是值得提倡的行为。我们应当设法积极引导青少年，适时地进行早期性教育，将这方面的精力转移到学习或其他活动中去，防止频繁发生（D对ABCE错）。